某病发病率维持历年的一般水平，表现为散在发生，数量不多，这样的流行强度称为
A. 暴发
B. 流行
C. 散发
D. 大流行
E. 有季节性

正确答案：C。散发

解析：散发：某病发病率维持历年的一般水平，各病例间无明显的时、空联系和相互传播关系，表现为散在发生，数量不多，这样的流行强度称为散发。掌握“流行病学资料与疾病分布”知识点。